三叉神经痛首选
A. 氯硝西泮
B. 苯妥英钠
C. 卡马西平
D. 氯丙嗪
E. 丙米嗪

正确答案：C。卡马西平